体内药量与血药浓度的比值，称为
A. 生物半衰期
B. 体内总清除率
C. 表观分布容积
D. 零级速度过程
E. 生物利用度

正确答案：C。表观分布容积

解析：本题考查常用的药物动力学参数。体内药量与血药浓度的比值，称为表观分布容积（C对）。表观分布容积（V）：表观分布容积是体内药量与血药浓度间关系的一个比例常数，用V表示。生物半衰期（A错）：生物半衰期是指体内药量或血药浓度消除一半所需要的时间。生物半衰期是衡量一种药物从体内消除速度的参数。体内总清除率（B错）（TBCL）： 体内总清除率或清除率是指单位时间内从机体或器官能清除掉相当于多少体积的体液中的药物。清除率常用Cl表示，单位为：体积·时间⁻¹。零级速度过程（D错）：系指药物的转运速度在任何时间都是恒定的，与血药浓度无关。临床上恒速静脉滴注的给药速度以及控释制剂中药物的释放速度等为零级速度过程，亦称零级动力学过程。生物利用度（E错）：生物利用度是指药物吸收进入血液循环的程度与速度。生物利用度包括两方面的内容：生物利用程度与生物利用速度。